对于髋关节的描述，正确的是
A. 属于杵臼关节
B. 关节囊薄弱，韧带较少
C. 股骨颈骨折发生在关节囊内
D. 有髂股韧带限制过屈
E. 运动幅度比肩关节大

正确答案：A。属于杵臼关节

解析：杵臼关节与球窝关节相似，但关节窝很深，可包绕关节头的1/2以上，这种关节叫杵臼关节。杵臼关节属于多轴关节、可沿多个轴作多种运动，但其运动范围小于球窝关节，其坚固程度大于球窝关节。髋关节属于杵臼关节（A对）。髋关节关节囊坚韧，周围有多条韧带加强（B错），其中髂骨韧带可以限制关节过伸（D错）。髋关节关节囊向上附着于髋臼周缘和横韧带，向下前面附着于股骨转子间线，后面包裹股骨颈的内侧 2/3，未包绕全部股骨颈，所以股骨颈骨折并非一定发生在关节囊内（C错），也可能在关节囊外。髋关节运动幅度不如肩关节(E错），肩关节为全身最灵活的关节，相对于髋关节它还可以多做一个环转运动。